1岁女孩，多汗，睡眠不安，体检：方颅，鸡胸I°，化验：血钙稍低，血磷明显降低，碱性磷酸酶明显增高，X线检查：干骺端呈毛刷样，并有杯口状改变。此患儿佝偻病分度应为
A. 轻度
B. 中度
C. 重度
D. 极重度
E. 以上都不是

正确答案：B。中度

解析：本题考查佝偻病的诊断分度。该患儿从体检的体征、化验结果与X线检查，均为佝偻病中度（B对ACDE错）。佝偻病诊断分度：1.轻度：只有轻度的骨骼改变如方颅、颅骨软化、肋串珠及肋膈沟，或有某些神经症状。血钙近于正常，血磷低，碱性磷酸酶正常或稍增高。X线检查正常或可见干骺端临时钙化带模糊。2.中度：已发现较明显的骨骼体征，如鸡胸、肋串珠、肋膈沟、囟门大出牙延迟，手（脚）镯及下肢畸形等，血钙稍低，血磷低，碱性磷酸酶明显升高。X线检查具有典型的活动性佝偻病征象。3.重度：严重骨骼畸形，如重度鸡胸、漏斗胸、脊柱弯曲，或有运动功能障碍，神经精神发育滞缓，营养障碍及贫血等。血钙、磷均降低，碱性磷酸酶显著增高。X线表现除活动性佝偻病征象外，尚有严重畸形或骨折。